女性，36岁。突然寒战高热，腰痛并尿急、尿痛1周，既往无类似病史，检查：体温39度，右侧肾区叩击痛阳性，尿蛋白（+），白细胞20～30个/HP，白细胞管型0～2个/低倍，比重1.022。此病人最可能是
A. 感染
B. 肾结石并泌尿系感染
C. 膀胱炎
D. 急性肾盂肾炎
E. 肾炎合并泌尿系感染

正确答案：D。急性肾盂肾炎

解析：中年女性患者（尿路感染的好发人群），起病急，突发寒战高热，腰痛并尿急，尿痛1周（急性肾盂肾炎的临床表现），体温39℃（超过38℃应考虑上尿路感染可能），右侧肾区叩击痛阳性，尿蛋白（+），白细胞20～30个/HP（提示尿路感染可能），有白细胞管型，比重1.022（正常值1.015～1.025），考虑本病为突然发病，此前又无类似症状，所以此病患最可能是急性肾盂肾炎（D对）。肾结石合并泌尿系统感染（B错）会出现类似症状，但平时会有腰痛和血尿等表现。膀胱炎（C错）一般无全身感染症状，少数患者出现腰痛、发热，但体温常不超过38℃。肾炎合并尿路感染（E错）会有类似症状，但平时会有肾炎的表现如血尿、蛋白尿、高血压和水肿。